下列哪种方法对减少或消除流行病学研究中的偏倚无效
A. 增加样本量
B. 遵循随机化原则
C. 实施盲法
D. 严格质量控制
E. 选择适宜的研究对象

正确答案：A。增加样本量

解析：本题考查控制偏倚的方法。偏倚可通过以下方式得以控制，包括：①遵循随机化原则（B对）；②实施盲法（C对）；③严格质量控制（D对）；④选择适宜的研究对象（E对）。增大样本量（A错，为本题正确答案）无法减少或消除偏倚，反而会因为增大工作量造成更大的偏倚。